女，大便性状改变，距肛门10cm处发现肿块，首选术式
A. Miles手术
B. 放射治疗
C. Hartmann手术
D. 姑息手术
E. 直肠低位前切除术

正确答案：E。直肠低位前切除术

解析：患者女，大便性状改变，距肛门10cm处发现肿块，首选直肠低位前切除术（E对）。“腹会阴切除术(Miles手术）：直肠癌根治术，同时经腹部、会阴两个入路进行整块肿瘤切除和淋巴结清扫。会阴部需切除部分肛提肌、坐骨肛门窝内脂肪、肛管及肛门周围约3～5cm的皮肤、皮下组织及全部肛管括约肌,于左下腹行永久性乙状结肠单腔造口”（A错）。“经腹直肠癌切除、近端造口，远端封闭手术(Hartmann手术）：切除肿瘤后近端结肠造口，远端残腔封闭。由于避免了肛门部操作，手术时间缩短，适用于一般情况很差，不能耐受Miles手术或急性梗阻不宜行Dixon手术的病人”（C错）。(P393)“姑息手术：晚期直肠癌的姑息手术以解除痛苦和处理并发症为主要目的。例如：排便困难或肠梗阻可行乙状结肠双腔造口；肿瘤出血无法控制可行肿瘤姑息性切除”（D错）。